唾液的功能不包括
A. 消化作用
B. 吸收作用
C. 溶媒作用
D. 冲洗作用
E. 排泄作用

正确答案：B。吸收作用

解析：本题考查唾液的作用。唾液的功能不包括吸收作用（B错，为本题的正确答案）。唾液的作用：1.消化作用（A对）：唾液中的淀粉酶，属于α淀粉酶，主要由腮腺产生，能分解淀粉或麦芽糖。由于唾液淀粉酶作用的适合pH为6～8，在食团与胃酸接触作用后，唾液淀粉酶迅速失活。2.咀嚼的辅助作用：唾液使食物湿润，易于嚼碎，并易于形成食团。3.溶媒作用（C对）：唾液可溶解食物中的有味物质，使之弥散与味蕾接触而产生味觉，尤其是在含水分少的食物中发挥重要作用。4.润滑作用：唾液可保持口腔组织的湿润、柔软、润滑，使咀嚼、吞咽、言语功能顺利进行。5.保护作用：唾液中的黏蛋白吸附至口腔黏膜表面，形成一层薄膜。该膜既可防止组织脱水，又可阻止外源性刺激物进入黏膜内。唾液黏蛋白或者糖蛋白吸附至牙面形成生物膜，称为获得性膜，能够修复和保护釉质表面，影响口腔微生物对牙面的附着。6.缓冲和稀释作用：唾液可以缓冲口腔内的酸碱度；当刺激性强的物质进人口腔时，唾液分泌增多以稀释其浓度；过冷或者过热的刺激可通过唾液缓冲，使口腔组织得到保护。7.清洁作用（D对）：唾液具有流动性，并且有一定的流量与流速，可清洁口腔内的食物残渣、细菌、脱落上皮等。8.杀菌抗菌作用：唾液中含的溶菌酶和分泌性免疫球蛋白等具有杀菌和抗菌作用。9.黏附和固位作用：唾液具有吸附性，可在口腔黏膜表面扩散成薄膜，有利于修复体的固位。10.缩短凝血时间作用：血液与唾液混合，则凝血时间缩短。该作用程度与混合的比例有关，当血液与唾液之比为1：2时，凝血时间缩短最多。11.排泄作用（E对）：血液中异常或者过量的成分常可通过唾液排出。12.体液的调节作用：当出汗、腹泻时，体内水分减少，血浆渗透压升高，此时唾液的分泌量则减少，以调节体液量。唾液的分泌还与季节变化有关，夏季较少，冬季较多。13.内分泌作用：下颌下腺分泌唾液腺激素，腮腺分泌腮腺素，除具有维持腺体的正常分泌活动外，还与无机物代谢及糖代谢有关，可促进骨和牙齿硬组织的发育。